黏膜相关系统的B细胞在黏膜局部受抗原刺激后可产生
A. SIgA
B. IgM
C. IgG
D. IgD
E. IgE

正确答案：A。SIgA